有关颈内动脉的描述正确的是
A. 在环状软骨上缘由颈总动脉发出
B. 经颈动脉管进入颅前窝
C. 在颈部发出分支、并与颈外动脉的分支吻合
D. 供应脑的全部血供
E. 分支分布于视器和脑

正确答案：E。分支分布于视器和脑

解析：颈内动脉在颈部无分支，自颈总动脉发出后，垂直上行至颅底，经颈动脉管入颅腔。颈内动脉分支分布于视器和脑（E对）。